患者男，28岁，血常规显示白细胞计数13.1×10⁹/L、中性粒细胞比例86.9%。可导致这种血象变化的情况有
A. 带状疱疹
B. 流行性感冒
C. 细菌性感染
D. 过敏性疾病
E. 骨髓增殖性疾病

正确答案：C、E。细菌性感染；骨髓增殖性疾病

解析：本题考查引起中性粒细胞增多的原因。细菌性感染（C对）和骨髓增殖性疾病（E对）可引起中性粒细胞增加。白细胞计数正常参考值为成人末梢血（4.0～10.0）×10⁹/L，成人静脉血（3.5～10.0）×10⁹/L，白细胞分类计数中中性分叶核粒细胞0.50～0.70（50%～70%），该题目中患者白细胞计数为13.1×10⁹/L，中性粒细胞比例为86.9%，均高于正常参考值。引起中性粒细胞增加的有：细菌性感染和化脓性炎症、中毒、急性大出血、白血病、骨髓增殖性疾病及恶性肿瘤、严重的组织损伤及大量红细胞破坏（严重外伤、大手术、大面积烧伤）。带状疱疹（A错）、流行性感冒（B错）、过敏性疾病（D错）会引起中性粒细胞减少。